目前用于控制支气管哮喘患者气道高反应最主要的措施是
A. 使用H₁受体拮抗剂
B. 吸入支气管舒张剂
C. 特异性免疫治疗
D. 吸入糖皮质激素
E. 使用白三烯调节剂

正确答案：D。吸入糖皮质激素

解析：激素可以作用于气道炎症形成过程中得诸多环节，有效抑制气道炎症，而气道炎症是气道高反应性的重要机制，因此吸入糖皮质激素（D对）是目前用于控制支气管哮喘患者气道高反应最主要的措施。H₁受体拮抗剂（A错）可通过抑制粘附因子（粘附分子是参与机体炎症反应和免疫反应的重要成分）来阻断及抑制气道反应性炎症中的嗜酸性粒细胞浸润和T淋巴细胞、单核细胞的趋化活性，虽然可以通过控制气道炎症进而影响气道高反应性，但不是哮喘临床常用的药物。吸入支气管舒张剂（B错）（例如：SAMA、SABA）主要用于哮喘急性发作的治疗，对控制哮喘患者气道高反应性无明显作用。特异性免疫治疗（C错），如：抗IgE抗体疗法，主要用于经吸入ICS和LABA联合治疗后症状仍未控制且血清IgE水平增高的重症哮喘患者。白三烯调节剂（E错）通过调节白三烯的生物活性而发挥抗炎作用，同时可以舒张支气管平滑肌，并不控制气道高反应性，适用于阿司匹林哮喘、运动性哮喘和伴有过敏性鼻炎哮喘患者的治疗。